必须按照国务院卫生行政部门的有关规定，严格执行消毒隔离制度，防止发生院内感染和医源性感染的机构是
A. 疾病控制中心
B. 卫生监督所
C. 预防保健机构
D. 医疗保健机构
E. 卫生行政管理机构

正确答案：D。医疗保健机构

解析：须按照国务院卫生行政部门的有关规定，严格执行消毒隔离制度，防止发生院内感染和医源性感染的机构是医疗保健机构（D对）。